温经汤中配伍半夏意在.
A. 燥湿化痰而和胃
B. 和胃降逆而止呕
C. 降肺胃虚逆之气
D. 通降胃气而散结
E. 降逆散结而消痞

正确答案：D。通降胃气而散结

解析：温经汤方含吴茱萸、桂枝，以温经散寒，通利血脉；当归、川芎、丹皮活血养血；阿胶、白芍、麦冬，养血止血，滋阴润燥清热；人参、甘草益气健脾；半夏、生姜辛开散结，通降胃气（D对），以助祛瘀调经；甘草尚能调和诸药，共奏温经散寒、养血祛瘀之功，主治冲任虚寒，瘀血阻滞证。